咯血量较大而能骤然停止疾病是
A. 肺炎球菌性肺炎
B. 二尖瓣狭窄
C. 支气管扩张症
D. 肺结核空洞
E. 肺脓肿

正确答案：C。支气管扩张症

解析：支气管扩张咯血的原因是支气管动脉和肺动脉的终末支有扩张与吻合，有的毛细血管扩张形成血管瘤所致。由毛细血管瘤破裂引起的少量咯血可自行停止，但由于存在血管的病变，咯血常反复出现（C对）；肺炎球菌性肺炎，肺实质是处于高度充血状态的，小血管通透性增加，并可发生破裂而导致咯血，由于小血管可以发生血栓性脉管炎，导致血管腔鼻塞，通常不易引起大量咯血（A错）；二尖瓣狭窄可能会导致急性左心功能衰竭引起肺瘀血，从而出现咯血症状，需要及时治疗（B错）；肺结核空洞早期可出现咳嗽，咳痰比较少，空洞形成合并感染时痰液可呈黏液的脓性或带有咯血并有胸疼，严重者会有呼吸困难、胸闷、气喘。患者还会有结核中毒的症状，比如低热、乏力、盗汗、全身不适、食欲下降、体质消瘦、面颊潮红等。部分患者还伴有关节疼痛，在育龄期的妇女可出现月经失调的情况（D错）；肺脓肿很少出现咳血，但临床上少数情况下也可以诱发出现咳血。肺脓肿主要的临床表现为咳嗽，咳浓臭痰，发热等，严重时可出现休克（E错）。